有关医学伦理学基本规范的描述，不正确的是
A. 协调医务人员的人际关系
B. 以医务人员应履行的义务为内容
C. 以应该做什么、不应该做什么、如何做的形式出现
D. 是培养医务人员医学道德品质的具体标准
E. 是稳定不变的

正确答案：E。是稳定不变的

解析：医学伦理学基本规范是稳定性与变动性的统一，因此稳定不变是错误的。掌握“医学伦理学的基本规范”知识点。